属于阳离子表面活性剂的是
A. 羟苯乙酯
B. 聚山梨酯80
C. 苯扎溴铵
D. 硬脂酸钙
E. 卵磷脂

正确答案：C。苯扎溴铵

解析：本题考查表面活性剂。苯扎溴铵（C对）属于阳离子表面活性剂；羟苯乙酯（A错）为防腐剂；聚山梨酯80（B错）为非离子表面活性剂；硬脂酸钙（D错）为阴离子表面活性剂；卵磷脂（E错）为两性离子表面活性剂。